患者，男，24岁。颈项强痛，活动受限，头向患侧倾斜，项背牵拉痛，颈项部压痛明显，兼见恶风畏寒。治疗除取主穴外，还应选用的穴位是
A. 内关、外关
B. 肩井、后溪
C. 风池、合谷
D. 血海、阴陵泉
E. 肾俞、关元

正确答案：C。风池、合谷

解析：本题考查常见的病症的辩证、处方。题中患者以颈项强痛，活动受限，头向患侧倾斜，项背牵拉痛，颈项部压痛明显为主症，故诊断为落枕。恶风畏寒为风寒侵袭之象，故辨为风寒袭络证。外关主治热病；头痛、目赤肿痛、耳鸣、耳聋等头面五官病证；瘰疬；胁肋痛；上肢痿痹不遂。内关主治心脏疾患，胃腑疾病，中风，神志病，眩晕症和肘臂挛痛（A错）。肩井、后溪为落枕的主穴（B错）。落枕风寒袭络证可配风池、风府，合谷可治疗发热恶寒等外感病证，亦可选用（C对）。血海主治月经不调、痛经、经闭等月经病’瘾疹、湿疹、丹毒等血热性皮肤病。阴陵泉主治腹胀、腹泻、水肿、黄疸、小便不利等脾不运化水湿证；膝痛（D错）。肾俞、关元能振奋阳气（E错）。